下列有关孕激素的生理作用的叙述，正确的是
A. 使子宫内膜发生增生期变化
B. 使子宫内膜发生分泌期变化
C. 降低血浆低密度脂蛋白含量
D. 促使并维持女性第二性征的出现
E. 促进子宫收缩

正确答案：B。使子宫内膜发生分泌期变化

解析：孕激素能促使处于增生期的子宫内膜进一步增厚，并转化为分泌期内膜（B对）。使子宫内膜发生增生期变化（A错）、降低血浆低密度脂蛋白含量（C错）、促使并维持女性第二性征的出现（D错）以及促进子宫收缩（E错）均为雌激素的作用。